男性，52岁。1个月前发现左下后牙龈有小包，有时口腔内觉有咸水。曾有过左侧后牙夜痛，无其他不适。检查见左下第一前磨牙牙颈部楔状缺损，探硬，轻酸感；左下第二前磨牙牙颈部龋洞深，探无感觉，牙髓无活力，叩诊异常感；左下第一磨牙近中根尖部龈瘘，叩痛（-），牙髓活力正常。为明确患牙诊断进行的一项检查是
A. 咬诊
B. 温度测验
C. 松动度检查
D. 牙周袋探诊
E. X线片检查

正确答案：E。X线片检查

解析：必须对左下第二前磨牙进行X线片检查，才可以明确患牙诊断。掌握“慢性根尖周炎”知识点。